下列哪种偏倚不属于选择偏倚
A. 入院率偏倚
B. 现患-新发病例偏倚
C. 检出偏倚
D. 测量偏倚
E. 无应答偏倚

正确答案：D。测量偏倚